感染病原体后，仅引起机体发生特异性免疫应答，而临床上不出现特异性的症状和体征，称为
A. 显性感染
B. 潜伏性感染
C. 隐性感染
D. 病原携带状态
E. 一过性感染

正确答案：C。隐性感染